患者，男，60岁，诊断为2型糖尿病、糖尿病肾病，估算的肾小球滤过率（eGFR）为20.2ml/（min·1.73m²），可以用于降糖治疗且无需减量的药物是
A. 二甲双胍
B. 胰岛素
C. 利拉鲁肽
D. 利格列汀
E. 阿卡波糖

正确答案：D。利格列汀